非法行医明知假药，仍然使用该药品达80万，应
A. 处三年以上十年以下有期徒刑，并处罚金
B. 处十年以上有期徒刑、无期徒刑或者死刑，并处罚金或者没收财产
C. 处三年以下有期徒刑或者拘役，并处罚金
D. 处三年以上七年以下有期徒刑，并处罚金

正确答案：B。处十年以上有期徒刑、无期徒刑或者死刑，并处罚金或者没收财产

解析：本题考查生产、销售、提供假药的刑事责任。刑法第一百四十一条规定，生产、销售、提供假药的金额五十万元以上的属于其他特别严重情节，处十年以上有期徒刑、无期徒刑或者死刑（B对），并处罚金或者没收财产。根据《刑法》第一百四十一条规定，生产、销售假药的，处三年以下有期徒刑或者拘役，并处罚金（C错）；对人体健康造成严重危害或者有其他严重情节的，处三年以上十年以下有期徒刑，并处罚金（A错）。根据《刑法》第一百四十二条之一规定，违反药品管理法规，编造生产、检验记录的，足以严重危害人体健康的，处三年以下有期徒刑或者拘役，并处或者单处罚金；对人体健康造成严重危害或者有其他严重情节的，处三年以上七年以下有期徒刑（D错），并处罚金。